功能祛风散寒止痛，善治巅顶头痛的药物是
A. 白芷
B. 藁本
C. 细辛
D. 吴茱萸
E. 苍耳子

正确答案：B。藁本

解析：题中药物除吴茱萸外均能祛风散寒止痛，白芷用于治疗阳明头痛，眉棱骨痛（A错）。藁本用于治疗厥阴头痛，即巅顶头痛（B对）。细辛用于治疗少阴头痛（C错）。吴茱萸用于治疗厥阴头痛，即巅顶头痛，但无祛风之功效（D错）。苍耳子用于治疗前额及鼻内胀痛（E错）。